结构中不含有酚羟基，易通过血脑屏障，会产生较强中枢兴奋副作用的肾上腺素能药物是
A. 肾上腺素
B. 重酒石酸间羟胺
C. 沙丁胺醇
D. 沙美特罗
E. 盐酸麻黄碱

正确答案：E。盐酸麻黄碱

解析：本题考查给药途径。盐酸麻黄碱（E对）实际结构中不含有酚羟基，易通过血脑屏障，是一种能产生较强中枢兴奋副作用的肾上腺素能药物。麻黄碱结构中羟基为醇羟基，具有拟肾上腺素能作用，有中枢兴奋副作用，临床常用来治疗哮喘。肾上腺素（A错）是具有酚羟基结构的药物。将异丙肾上腺素苯核3位的酚羟基用羟甲基取代，N原子上的异丙基用叔丁基取代，即可得到沙丁胺醇。沙丁胺醇（C错）是含有叔丁胺基结构的肾上腺素能药物；沙丁胺醇的侧链氮原子上的叔丁基用一长链的亲脂性取代基取代得到沙美特罗（D错），是一长效β₂受体激动剂。重酒石酸间羟胺（B错）主要作用于α受体，用于急性低血压。